T细胞不能
A. 产生细胞因子
B. 直接杀伤靶细胞
C. 参与对病毒的免疫应答
D. 介导ADCC效应
E. 诱导抗体的类别转换

正确答案：D。介导ADCC效应

解析：T细胞是淋巴细胞的主要组分，它具有多种生物学功能，如直接杀伤靶细胞（B对），辅助或抑制B细胞产生抗体，诱导抗体的类别转化（E对）（Th2细胞释放IL-4诱导由B细胞分化成浆细胞并合成IgE的关键细胞因子），对特异性抗原和促有丝分裂原的应答反应以及产生细胞因子（A对）等。CTL细胞可高效、特异的杀伤病毒感染的靶细胞（C对），而不损害正常细胞。ADCC（抗体依赖的细胞介导的细胞毒性作用）是指表达IgGFc受体的NK细胞、巨噬细胞和中性粒细胞等，通过与已结合在病毒感染细胞和肿瘤细胞等靶细胞表面的IgG抗体的Fc段结合，而杀伤这些靶细胞的作用，与B细胞有关（D错，为本题正确答案）。